第三磨牙的形态特点中哪一点是错误的
A. 牙的形态、大小、位置变异很多
B. 上颌第三磨牙与上颌第二磨牙相似
C. （牙合）面副沟多
D. 根多合并成一锥形根
E. 牙尖和边缘嵴明显

正确答案：E。牙尖和边缘嵴明显

解析：本题考查第三磨牙的形态特点。牙尖和边缘嵴明显（E错，为本题正确答案）不符合第三磨牙的形态特点。第三磨牙的尖、嵴、窝、沟均不明显，副沟较多。第三磨牙易发生先天缺失或形态位置异常，常见变异（A对）。在未发生变异时，上颌第三磨牙的标准形态与上颌第二磨牙相似（B对），但牙冠较小，根较短，各轴面中1/3较圆突，颊舌面外形高点均在中1/3处。牙冠颊面自近中向远中向舌侧的倾斜度更大，远中舌尖很小或缺如，颊面宽于舌面，牙合面呈圆三角形，副沟多（C对）。有时牙尖多而界限不清。牙根变异很大，多数合并成一锥形根（D对）。